初产妇枕先露时，开始保护会阴的时间是
A. 宫口开全时
B. 胎头可见到时
C. 胎头着冠时
D. 胎头复位时
E. 胎头拨露使阴唇后联合紧张时

正确答案：E。胎头拨露使阴唇后联合紧张时

解析：当胎头到达阴道口时即会使阴唇后联合紧张，引起会阴撕裂，因此当胎头拨露使阴唇后联合紧张时（E对）开始保护会阴，这是预防会阴撕裂的关键。宫口开全（A错）时胎头还没有到阴道口。胎头着冠时（P180）（C错）是指胎头双顶径越过骨盆出口，宫歇间期时胎头不再回缩，此时开始保护会阴已过晚。胎头复位（P175）（D错）是指胎头娩出后，为使胎头与胎肩恢复正常关系，胎头枕部再向左旋转45°，此时胎头已出阴道口。